患者，女，55岁。近1年来反复出现颜面及下肢浮肿，面色无华，乏力气短，腰膝酸软，五心烦热，咽干，舌红，少苔，脉沉细。尿蛋白（﹢﹢），伴有镜下血尿。应首先考虑的诊断是
A. 急性肾小球肾炎肾阴亏虚证
B. 慢性肾小球肾炎肾阳衰微证
C. 肾病综合征脾虚湿困证
D. 慢性肾小球肾炎气阴两虚证
E. 肾病综合征肾阳衰微证

正确答案：D。慢性肾小球肾炎气阴两虚证

解析：患者近1年来反复出现颜面及下肢浮肿，尿蛋白（﹢﹢），伴有镜下血尿，故可诊断为慢性肾小球肾炎。阳气虚衰，不能上荣，故见面色无华；气虚推动无力，故见乏力气短；腰为肾之府，肾阴虚故见腰膝酸软；阴虚不能制约阳气，阴虚阳亢则产生虚热，故见五心烦热；阴虚失于滋养，故见咽干；舌红，少苔，脉沉细，均为气阴两虚证的表现。治法为益气养阴，方药选用参芪地黄汤加减（D对）。患者近一年来反复出现症状，故为慢性病（A错）。肾病综合征表现为大量蛋白尿，低白蛋白血症，水肿，高脂血症（CE错）。慢性肾小球肾炎肾阳衰微证表现为全身浮肿，面色苍白，畏寒肢冷，腰脊冷痛，神疲，纳少，便溏，遗精，阳痿，早泄，或月经失调，舌嫩淡胖，有齿痕，脉沉细或沉迟有力（B错）。